下列关于外环境与疾病发生关系的叙述，错误的是
A. 久视伤血
B. 久坐伤肉
C. 久立伤骨
D. 久思伤心
E. 久行伤筋

正确答案：D。久思伤心

解析：本题是对经典原文的考查，属于记忆内容。《素问·宣明五气篇》：“久视伤血（A对），久卧伤气，久坐伤肉（B对），久立伤骨（C对），久行伤筋（E对），是谓五劳所伤。”“久思伤心”不是五劳所伤的内容（D错，为本题正确答案）。